《学校卫生条例》规定，对因为体育场地和器材不符合卫生和安全要求导致人为伤害的学校，卫生行政部门对直接责任单位和个人给予下列哪种形式的处罚
A. 警告并限期改进，情节严重的，可建议教育行政部门给予行政处分
B. 警告
C. 警告并限期改进，情节严重的，同时处以200元以下的罚款
D. 警告并限期改进，情节严重的，可建议教育行政部门给予行政处分，并处以200元以下的罚款
E. 警告并限期改进

正确答案：A。警告并限期改进，情节严重的，可建议教育行政部门给予行政处分